预防神经管畸形的营养素是
A. 碘
B. 叶酸
C. 维生素A
D. 硫胺素
E. 烟酸

正确答案：B。叶酸